上颌牙列的Wilson曲线是一条
A. 凸向上的曲线
B. 凸向下的曲线
C. 凹向上的曲线
D. 凹向下的曲线
E. 与（牙合）平面平行

正确答案：B。凸向下的曲线

解析：横（牙合）曲线又称Wilson曲线。上颌两侧磨牙在牙槽中的位置均略向颊侧倾斜，使舌尖的位置低于颊尖，因此，连接两侧同名磨牙的颊尖、舌尖形成一条凸向下的曲线，称横（牙合）曲线。掌握“牙列”知识点。